糖尿病微血管病变可见
A. 下肢疼痛或间歇性跛行
B. 视物模糊，眼底可见微血管瘤
C. 直立性低血压，少汗或多汗，心动过速
D. 双下肢麻木，灼热或如踏棉垫感
E. 外阴瘙痒

正确答案：B。视物模糊，眼底可见微血管瘤

解析：微血管病变主要有糖尿病肾病和视网膜病变糖尿病性视网膜病变常发生于糖尿病病程超过10年者，是失明的主要原因之一。糖尿病视网膜病变分为两大类、六期。在一期的时候就会出现微血管瘤、视物模糊的症状，随着病情进一步发展症状也会越来越严重，最终导致视网膜脱离、失明（B对）。下肢疼痛或间歇性跛行是由于糖尿病下肢动脉硬化闭塞症导致的（A错）。直立性低血压，少汗或多汗，心动过速多认为是由于中枢神经系统或周围自主神经系统变性，继而导致中枢或周围自主神经系统的功能失调（C错）。双下肢麻木，灼热或如踏棉垫感是由于周围神经病变导致（D错）。糖尿病患者有外阴瘙痒主要是由于尿糖高容易滋生细菌导致的（E错）。